结合心电图检查结果，临床诊断为稳定型心绞痛。该患者不宜选用
A. 比索洛尔片
B. 阿司匹林肠溶片
C. 依那普利片
D. 阿托伐他汀钙片
E. 硝酸甘油片

正确答案：A。比索洛尔片

解析：本题考查稳定型心绞痛的药物治疗。比索洛尔（A错，为本题正确答案）属于β受体阻断剂，β受体阻断剂可抑制心脏β肾上腺素能受体，减慢心率、减弱心肌收缩力、降低血压，从而降低心肌耗氧量以减少心绞痛发作和增加运动耐量。长期服用可显著降低心血管事件及死亡率。用药后要求静息心率降至55～60次／分。有严重心动过缓、高度房室传导阻滞及支气管哮喘急性发作的患者，禁用β受体阻断剂。正常人心跳次数是60～100次/分，小于60就称为心动过缓。该题目中的患者心率55次/min，为心动过缓，因此该患者不宜应用比索洛尔进行治疗。阿司匹林肠溶片（B对）为抗血小板药物，主要用于支架植入以后及阿司匹林有禁忌症的患者，胃肠道出血和对阿司匹林过敏者，应改为氯吡格雷替代治疗。依那普利片（C对）为ACEI类药物，用于稳定性心绞痛合并高血压、糖尿病、心力衰竭的患者。ACEI类可引起干咳，不能耐受者可使用ARB类药物。阿托伐他汀钙片（D对）为他汀类药物，所有冠心病患者，无论其血脂水平如何，均应给予他汀类药物。他汀类药物总体安全性很高。硝酸甘油片（E对）为硝酸酯类药，心率反射性加快和低血压患者应禁用硝酸甘油片。